有关鼓室的描述中，正确的是
A. 是颞骨岩部内与外界不通的小腔
B. 下壁为乳突壁
C. 位于外耳与颅后窝之间
D. 内有2块听小骨、3块听小肌
E. 婴儿骨部和软骨部发育未完全，故检查时须将耳廓向后下方牵拉

正确答案：E。婴儿骨部和软骨部发育未完全，故检查时须将耳廓向后下方牵拉

解析：鼓室是颞骨岩部内（C错）含气的不规则小腔（A错）。下壁称颈静脉壁（B错）。鼓室内有锤骨、砧骨和镫骨3块听小骨，有鼓膜张肌和镫骨肌2块听小肌（D错）。检查婴儿鼓膜时须将耳廓向后下方牵拉（E对）。